女，9个月，8Kg。发热、呕吐腹泻3天，大便蛋花汤样，无腥臭味，尿量明显少。精神萎靡，皮肤弹性差，眼凹陷，唇樱红，四肢凉，诊断为婴儿腹泻，血钠132mmol/L。第一天补液总量和张力应为
A. 720ml，1/2张
B. 1040ml，1/2张
C. 1100ml，2/3张
D. 1200ml，2/3张
E. 1400ml，2/3张

正确答案：B。1040ml，1/2张

解析：该患儿有腹泻的病史，并且有尿量明显少、精神萎靡、皮肤弹性差、眼凹陷、四肢凉的临床表现，应诊断为中度脱水，该患儿血钠132mmol/L，应诊断为等渗性脱水，综上该患儿为中度等渗性脱水，通常等渗性脱水应选择1/2张液，中度脱水第一天为120～150ml/kg，该患儿体重是8kg，所以补液总量960～1200ml（B对）。